女，38岁，G2P2，接触性阴道流血半年，妇科检查，外阴阴道无异常，宫颈糜烂状，下唇略突起，宫体正常大小，双附件区未触及包块，双合诊双侧宫旁无异常，TCT检查示HSIL，高危型HPV阳性，若结果显示HSIL（CIN3）累积腺体，6点处为鳞状细胞癌，局部间质浸润深度8mm，最适合的手术方式
A. 广泛性子宫切除术+盆腔淋巴结切除术
B. 宫颈椎切术
C. 筋膜外全子宫切除术
D. 改良广泛性子宫切除术+盆腔淋巴结切除术
E. 筋膜内全子宫切除术

正确答案：A。广泛性子宫切除术+盆腔淋巴结切除术

解析：根据表29-1 子宫颈癌临床分期（FIGO，2009年）（P301）：所有肉眼可见的病灶，包括浅表浸润，均为ⅠB期，且临床癌灶≤4为ⅠB1期，ⅠB1期的手术方式为广泛性子宫切除+盆腔淋巴结切除术（A对）。改良子宫颈切除+盆腔淋巴结切除术（D错）适用于肿瘤直径<2cm的ⅠB1期且要求保留生育功能的年轻患者。筋膜外子宫切除术（CE错）适用于宫颈锥形切除术（B错）适用于对要求保留生育功能的ⅠA1期年轻患者。